肾上腺素可引起的不适中，不包括
A. 心悸
B. 恐惧
C. 颤抖
D. 头痛
E. 麻木

正确答案：E。麻木

解析：本题考查肾上腺素可引起的不良反应。肾上腺素的药理作用主要有正性肌力作用，对血管小剂量收缩血管大剂量舒张血管，对血流动力学影响及舒张支气管平滑肌的作用，对神经无影响，不会造成麻木（E错，为本题的正确答案）。由于血管的正性肌力作用使心肌收缩力增强，心率加快，故可造成心悸（A对），恐惧（B对）；同时大剂量的肾上腺素可使动脉收缩压及舒张压均增高加上心率加快可能会造成颤抖（C对）；血压的大幅升高可造成头痛（D对）。